患者，男，65岁。慢性肺源性心脏病史5年。近日受凉后发热，咳喘加重，面色暗，口唇发绀，呼吸急促，舌红苔黄腻，脉弦滑数。其证型是
A. 痰浊阻肺
B. 痰热壅肺
C. 寒饮内停
D. 阴竭阳脱
E. 痰蒙神窍

正确答案：B。痰热壅肺

解析：痰热壅阻肺气，肺失清肃，故咳喘大作，呼吸急促，咯吐黄痰；肺热内蕴则有身热；舌暗苔黄腻，脉滑数均为痰热壅肺之侯，故属于痰热壅肺（B对）。痰浊阻肺（A错）的特点为咳嗽反复发作，咳声重浊，痰多，因痰而嗽，痰出咳平，痰黏腻色白，胸闷，脘痞；寒饮内停（C错）的特点为畏寒肢冷，咳痰清稀量多；阴竭阳脱（D错）的特点为神志昏迷，脉微细欲绝；痰蒙神窍（E错）的特点为神志恍惚，抽搐，痰白腻或黄腻，舌质暗红，脉细滑数。